《中华人民共和国药品管理法》规定，非药品不得
A. 有涉及药品的宣传广告
B. 在大众传播媒介发布广告
C. 发布广告
D. 在零售药店销售
E. 在医学、药学专业刊物上介绍

正确答案：A。有涉及药品的宣传广告

解析：本题考查药品管理。《中华人民共和国药品管理法》规定，非药品不得有涉及药品的宣传广告（A错，为本题正确答案）。